可拮抗华法林凝血作用的药品是
A. 亚叶酸钙
B. 维生素B₆
C. 乙酰半胱氨酸
D. 还原性谷胱氨肽
E. 维生素K₁

正确答案：E。维生素K₁

解析：本题考查拮抗华法林凝血作用的药品。华法林的抗凝血作用能被维生素K₁（E对）拮抗。华法林能竞争性抑制维生素K环氧化物还原酶，故可被维生素K拮抗。